小儿前囟闭合的正常时间是
A. 4～6个月
B. 8～10个月
C. 12～18个月
D. 18～20个月
E. 20～22个月

正确答案：C。12～18个月

解析：前囟为顶骨和额骨边缘形成的菱形间隙，其大小以对边中点连线长度进行衡量，出生时约1.0～2.0cm，以后随颅骨发育而增大，6个月后逐渐骨化而变小，约在1～1.5岁时闭合；后囟在出生时即已很小或已闭合，最迟约于生后6～8周闭合；颅骨缝在生后3～4个月闭合（C对）。